肺胀患者，烦躁不安，谵妄。下列治疗措施中，错误的是
A. 立刻静注氨茶碱
B. 吸痰
C. 灌服安宫牛黄丸
D. 吸氧
E. 注射山梗菜碱（洛贝林）

正确答案：A。立刻静注氨茶碱

解析：肺胀患者，烦躁不安，谵妄，为急性加重期的临床表现，当选择有效的抗菌药物控制感染，同时配合祛痰药等改善相应症状。吸痰（B对）解除呼吸道阻塞情况，灌服安宫牛黄丸（C对）清热醒神开窍，吸氧（D对）改善缺氧情况、注射山梗菜碱（洛贝林）（E对）为呼吸中枢兴奋剂，这些都是针对急性症状的治疗。氨茶碱为良好的平喘药，用于支气管哮喘的治疗。肺胀患者虽有喘息症状，但氨茶碱（A错，为本题正确答案）起效慢，不适于急症的治疗当选用起效更快的β₂受体激动剂，如沙丁胺醇等。